下列除哪项外，均可引起阻塞性黄疸
A. 疟疾
B. 胆管癌
C. 肝癌
D. 胆道蛔虫症
E. 胆总管结石

正确答案：A。疟疾

解析：胆管癌（B对）、肝癌（C对）、胆道蛔虫症（D对）、胆总管结石（E对）时，由于胆道阻塞，阻塞上方胆管内压力升高，胆管扩张，致小胆管与毛细胆管破裂，胆汁中的胆红素反流入血，均可引起阻塞性黄疸。疟疾（A错，为本题正确答案），恶性疟疾时，红细胞大量破坏，发生DIC,可出现溶血性黄疸。